患者入院后，不顾病情继续坚持写论文，患者的行为属于
A. 角色行为异常
B. 角色行为冲突
C. 角色行为减退
D. 角色行为缺如
E. 全部不正确

正确答案：C。角色行为减退

解析：角色适应不良包括角色行为缺如、角色行为冲突、角色行为减退、角色行为强化、角色行为异常。个体进入病人角色后，由于某种原因又重新承担起本应娩出的社会角色的责任，放弃了病人角色去承担其他角色的活动（C对）。本题中的患者入院后，没能进入病人角色，仍然坚持工作，属于典型的角色行为减退。角色行为异常（A错）是病人无法承受患病或不治之症的挫折和压力，对病人角色感到厌倦、悲观、绝望，由此导致行为异常。角色行为冲突（B错）是当多种社会地位和多种角色集于一人时，在其自身内部产生的冲突。角色行为缺如（D错）是病人未能进入病人角色，不承认自己是病。